从东南亚入境一男子，3天前因突然剧烈呕吐、腹泻而入院。腹泻物呈米泔水样，便检发现穿梭状运动的细菌，请问致病菌可能是
A. 副溶血弧菌
B. 肠炎杆菌
C. 鼠伤寒沙门菌
D. 产气荚膜梭菌
E. 霍乱弧菌

正确答案：E。霍乱弧菌